肛裂的典型临床表现是
A. 排便不尽
B. 里急后重
C. 黑便
D. 脓血便
E. 排便后肛门疼痛

正确答案：E。排便后肛门疼痛

解析：肛裂的典型临床表现是便秘、出血和疼痛（便后周期疼痛）（E对）。排便不尽（A错）多由慢性肠炎引起。里急后重（B错）提示肛门、直肠疾病，见于痢疾、酉肠炎及直肠癌。黑便（C错）多见于上消化道出血性疾病。肠道有炎症或受外界刺激，如细菌性肠炎，炎症性肠炎均可以造成肠道的粘膜受损，才会出现脓血便（D错）。